能引起电光性眼炎的是
A. 紫外线
B. 红外线
C. 高频电磁场
D. 无线电波
E. 微波

正确答案：A。紫外线